继发性腹膜炎最主要的临床表现是
A. 腹痛、腹胀
B. 腹膜刺激征
C. 叩出移动性浊音
D. 肠鸣音消失
E. 高热、脉快、疲乏

正确答案：B。腹膜刺激征

解析：继发性腹膜炎是由于腹腔脏器病变导致的腹膜炎症反应。主要表现为腹部压痛、反跳痛及腹肌紧张（B对）；腹痛腹胀为腹部疾病一般表现，不具有特异性（A错）；叩诊移动性浊音是腹水的表现（C错）；腹膜炎听诊时肠鸣音减弱，肠麻痹时肠鸣音可能完全消失（D错）；高热、脉快、疲乏常为感染中毒症状（E错）。